长期大量服用维生素E可出现
A. 颅内压上升
B. 肢端肥大
C. 乳腺肿大
D. 尿频和腹泻
E. 肝肾损害和骨骼硬化

正确答案：C。乳腺肿大

解析：本题考查维生素的不良反应。大量服用维生素E可引起视物模糊、乳腺肿大（C对）等症状；长期超量使用维生素E可引起血小板聚集和形成，血压升高，出现血栓危险。长期大量服用维生素A可引起慢性中毒，出现颅内压增高（A错）、全身不适、发热、夜尿增多、皮肤干燥或瘙痒、眼球突出、剧烈头痛等现象。维生素C偶见腹泻、皮肤红亮、头痛、尿频（D错）等；长期大量使用可引起泌尿系统尿酸盐、半胱氨酸盐或草酸盐结石。长期大量服用维生素D可出现肾脏损害、低热、惊厥、厌食、肝脏肿大，骨硬化等症（E错）。成年人长期使用生长激素类药物可引起肢端肥大症（B错）。